临床常用的促凝血药的类别包括
A. 促凝血因子合成药
B. 促凝血因子活性药
C. 促纤维蛋白溶解药
D. 影响血管通透性药
E. 血管紧张素转换酶抑制剂

正确答案：A、B、D。促凝血因子合成药；促凝血因子活性药；影响血管通透性药

解析：本题考查促凝血药的分类。临床常用的促凝血药包括：1.促凝血因子合成药（A对）；2.促凝血因子活性药（B对）；3.抗纤维蛋白溶解药；4.影响血管通透性药（D对）；5.蛇毒血凝酶；6.鱼精蛋白。促纤维蛋白溶解剂（C错）是溶栓药。血管紧张素转换酶抑制剂（E错）是抗高血压药。